下列药物中哪个是β-内酰胺酶抑制剂
A. 盐酸米诺环素
B. 头孢噻吩钠
C. 克拉维酸
D. 阿莫西林
E. 阿米卡星

正确答案：C。克拉维酸

解析：本题考查β-内酰胺酶抑制剂。克拉维酸（C对）为β-内酰胺酶抑制剂。盐酸米诺环素（A错）属广谱类抗生素，对四环素敏感或耐药的金黄色葡萄球菌均有效。头孢噻吩钠（B错）为第一代头孢菌素，抗菌谱广，对革兰阳性菌的活性较强。阿莫西林（D错）是广谱β-内酰胺类抗生素，杀菌作用强，对大多数致病的G⁺菌和G⁻菌均有强大的抑菌和杀菌作用。阿米卡星（E错）是一种氨基糖苷类抗生素，本品对多数肠杆菌科细菌均具良好作用。